下列有关处方的书写规则叙述中，正确的是
A. 每张处方限于1名患者的用药
B. 不得使用自用字样
C. 不得自行编制药品缩写名称
D. 不得使用遵医嘱字样
E. 以上均正确

正确答案：E。以上均正确

解析：以上选项都正确，符合处方的书写规则。掌握“处方的开具、监督管理及法律责任”知识点。